药物产生副作用的药理学基础是
A. 药物作用靶点特异性高
B. 药物作用部位选择性低
C. 药物剂量过大
D. 血药浓度过高
E. 药物分布范围窄

正确答案：B。药物作用部位选择性低

解析：本题考查药物产生副作用的药理学基础。药物产生副作用的药理学基础是药物作用部位选择性低（B对）。副作用是药物固有的药理作用所产生的，由于药物作用的选择性低，药理效应涉及多个器官，当某一效应用作为治疗目的时，其他效应就成为副作用。药物剂量过大（C错）和血药浓度过高（D错）会引起药物的毒性作用。